成年人上前牙外伤，冠折1/3，露髓，根（-）。其治疗原则为
A. 活髓切断术
B. 直接盖髓
C. 干髓术
D. 根管治疗
E. 塑化治疗

正确答案：D。根管治疗

解析：本题考查冠折的治疗。成年人上前牙外伤，冠折1/3，露髓，根（-）。其治疗原则为根管治疗（D对）。成年人前牙冠折露髓，应做根管治疗。年轻恒牙冠折露髓，应根据牙髓暴露和污染的程度作活髓切断术，以利于牙根的发育（A错）。直接盖髓适用于因机械或外伤性露髓的年轻恒牙，或者根尖已发育完全的机械性或外伤性露髓，其穿髓孔直径不超过0.5mm的恒牙（B错）。干髓术是去除感染的冠髓，保留干尸化的根髓，多用于乳磨牙牙髓炎的治疗（C错）。塑化剂的颜色与牙齿不相协调，可致塑化后的牙齿颈部甚至冠部出现变色，若用于前牙会影响美观（E错）。